抽样方法不包括
A. 单纯随机抽样
B. 系统抽样
C. 分层抽样
D. 整群抽样
E. 随意调查

正确答案：E。随意调查

解析：本题考查抽样方法。常见的抽样方法包括单纯随机抽样（A对）、系统抽样（B对）、分层抽样（C对）、整群抽样（D对）和多阶段抽样等。随意调查（E错，为本题正确答案）不是抽样方法。